女，28岁，于妊娠早期有早孕反应，尿HCG阳性。于妊娠17周时感有胎动。B超示单胎，头位，见心脏搏动。现为妊娠26周，近2周来自觉胎动停止，腹部不再增大，来门诊检查，宫底平脐，未闻及胎心，复查B超未见胎心搏动和胎动，最需要的实验室检查是
A. 白细胞计数分类
B. 血糖
C. 凝血功能检查
D. 肝功能
E. 肾功能

正确答案：C。凝血功能检查

解析：患者妊娠早期有早孕反应，尿HCG阳性，妊娠17周时感有胎动，B超示单胎，头位，见心脏搏动，现为妊娠26周（>20周），近2周来自觉胎动停止，腹部不再增大，来门诊检查，宫底平脐（提示子宫大小小于妊娠周数），未闻及胎心，复查B超未见胎心搏动和胎动（提示胎儿死亡），根据患者的临床症状、体征及B超检查，考虑临床诊断是死胎，最需要的实验室检查是凝血功能检查（C对），因为死胎在宫腔内停留过久可能引起母体凝血功能障碍，严重者可导致DIC。